当同一人群间隔一定时间进行筛选时，初次筛选检验出的临床前期长的病例比以后检出的比例要大，这些病例的生存期可能较长，这样引起的偏倚称为
A. 病程长短偏倚
B. 领先时间偏倚
C. 信息偏倚
D. 混杂偏倚
E. 以上都不是

正确答案：A。病程长短偏倚

解析：本题考查病程长短偏倚。病程长短偏倚是由于选择较长病程病例的比例不能代表所要研究的病例而产生的一种系统误差。当同一人群间隔一定时间进行筛选时，初次筛选检验出的临床前期长的病例比以后检出的比例要大，这些病例的生存期可能较长，这样引起的偏倚称为病程长短偏倚（A对BCDE错）。